滥用糖皮质激素，可能导致的药源性疾病是
A. 夜盲症
B. 高钙血症
C. 骨质疏松症
D. 溶血性贫血
E. 高脂血症

正确答案：C。骨质疏松症

解析：本题考查骨质疏松症。滥用糖皮质激素，可能导致的药源性疾病是骨质疏松症（C对）。夜盲症（A错）是视网膜杆状细胞缺乏合成视紫红质的原料或杆状细胞本身的病变引起的。高钙血症（B错）是肿瘤和甲状旁腺功能亢进引起的。溶血性贫血（D错）是红细胞本身的内在缺陷或红细胞外部因素异常导致。高脂血症（E错）可能由糖尿病、高血压、黏液性水肿、甲状腺功能低下、肥胖、肝肾疾病、肾上腺皮质功能亢进导致。